胸椎
A. 人椎体上有一对肋凹
B. 有乳突和副突
C. 棘突板状后伸
D. 关节突呈矢状位
E. 有横突肋凹

正确答案：E。有横突肋凹

解析：胸椎椎体两侧有上、下肋凹（A错），与肋头相关节，在横突末端前面，有横突肋凹与肋结节相关节 （E对）。腰椎上、下关节突粗大，关节面几呈矢状位（D错），上关节突后缘的卵圆形隆起称乳突（B错），棘突宽短呈板状，水平伸向后方（C错）。